甲硝唑的药理作用包括
A. 抗阿米巴滋养体作用
B. 抗滴虫作用
C. 抗疟原虫作用
D. 抗贾第鞭毛虫作用
E. 抗厌氧菌作用

正确答案：A、B、D、E。抗阿米巴滋养体作用；抗滴虫作用；抗贾第鞭毛虫作用；抗厌氧菌作用

解析：本题考查甲硝唑的药理作用。甲硝唑为硝基咪唑类抗菌药物，对滴虫（B对）、阿米巴（A对）和兰氏贾第鞭毛虫（D对）等原虫活性强，也用于各种厌氧菌感染（E对）。抗疟原虫（C错）药物主要有氯喹、奎宁、青蒿素、蒿甲醚等。